药品零售企业可以经营的肽类激素是
A. 列入兴奋剂目录的利尿剂
B. A型肉毒毒素
C. 复方盐酸伪麻黄碱缓释胶囊
D. 胰岛素注射剂

正确答案：D。胰岛素注射剂

解析：本题考查蛋白同化制剂、肽类激素的销售及使用管理。药品零售企业可以经营的肽类激素是胰岛素注射剂（D对）。严禁药品零售企业销售胰岛素以外的蛋白同化制剂或其他肽类激素。药品零售企业必须凭处方销售胰岛素以及其他按规定可以销售的含兴奋剂药品。零售药店的执业药师应对购买含兴奋剂药品的患者或消费者提供用药指导。含兴奋剂（A错）药品，在医疗临床上应用广泛，有许多含兴奋剂药品品种在零售药店中就可以购买到，就其治疗作用和不良反应而言，并无特别的含义。注射用A型肉毒毒素（B错）生产（进口）企业应当指定具有医疗用毒性药品收购经营资质和具有生物制品经营资质的药品批发企业作为本企业注射用A型肉毒毒素的经营企业，并且经指定的经营企业直接将注射用A型肉毒毒素销售至已取得《医疗机构执业许可证》的医疗机构或医疗美容机构。未经指定的药品经营企业不得购销注射用A型肉毒毒素。生产经营企业不得向未取得《医疗机构执业许可证》的单位销售注射用A型肉毒毒素；药品零售企业不得经营注射用A型肉毒毒素。药品零售企业销售含麻黄碱类复方制剂（C错），应当查验购买者的身份证，并对其姓名和身份证号码予以登记。除处方药按处方剂量销售外，一次销售不得超过2个最小包装。查验购买者的身份证，系指购买者合法有效的身份证件，包括居民身份证、军人证件、护照等。